某男，50岁。患眼疾5年，刻下目赤翳障，烂弦风眼，治当明目去翳、收湿生肌。医师准备为其配制点眼剂，宜选用的药物是
A. 升药
B. 枯矾
C. 炉甘石
D. 硼砂
E. 儿茶

正确答案：C。炉甘石

解析：本题考查的是炉甘石的用法用量。治当明目去翳、收湿生肌，医师准备为其配制点眼剂，宜选用的药物是炉甘石（C对）。炉甘石：【用法用量】外用：适量，研末撒或调敷，水飞点眼。升药（A错）：【用法用量】外用：适量，研末干掺。多与煅石膏研末同用，不用纯品。枯矾（B错）（又名煅白矾），为白矾煅制品。白矾：【用法用量】内服：入丸散，0.6～1.5g。外用：适量，研末敷，或化水洗患处。硼砂（D错）：【用法用量】外用：适量，研极细末，干撒或调涂；或沸水溶解，待温，冲洗创面。内服：入丸散，每次1～3g。儿茶（E错）：【用法用量】内服：煎汤，1～3g，布包；或入丸散。外用：适量，研末撒或调敷。